通过直接抑制凝血因子Xₐ而发挥作用的抗凝血药物
A. 依诺肝素
B. 氯吡格雷
C. 华法林
D. 利伐沙班
E. 达比加群酯

正确答案：D。利伐沙班

解析：本题考查抗凝药的分类。抗凝药的分类：①维生素K拮抗剂：华法林（C错）、双香豆素；②肝素类：肝素钠、肝素钙、达肝素钠、依诺肝素钠（A错）；③直接凝血酶抑制剂；达比加群酯（E错）；④直接Xa因子抑制剂：利伐沙班（D对）、阿哌沙班、艾多沙班。氯吡格雷（B错）为抗血小板药。